康复的原则有
A. 形神共养
B. 调养气血
C. 调养阴阳
D. 协调脏腑
E. 疏通经络

正确答案：A、B、C、D、E。形神共养；调养气血；调养阴阳；协调脏腑；疏通经络

解析：本题考查的是康复的原则。康复的原则有形神共养（A对）、调养气血（B对）、调养阴阳（C对）、协调脏腑（D对）与疏通经络（E对）。康复的原则：1.形神共养：（1）养形；（2）养神。2.调整阴阳气血：（1）调整阴阳；（2）调养气血。3.调养脏腑经络：（1）调理脏腑；（2）疏通经络。